附着水平是指
A. 龈缘到袋底的距离
B. 龈缘到牙槽嵴顶的距离
C. 釉牙骨质界到龈缘的距离
D. 釉牙骨质界到袋底的距离
E. 釉牙骨质界到牙槽嵴顶的距离

正确答案：D。釉牙骨质界到袋底的距离

解析：本题考查附着水平。釉牙骨质界至龈沟底或牙周袋底的距离（D对）为牙周附着水平。龈缘到袋底的距离（A错）为探诊深度。探诊深度和牙周附着水平是临床进行牙周探诊时主要采用的两个指标。龈缘到牙槽嵴顶的距离（B错）和釉牙骨质界到龈缘的距离（C错）临床上未见使用。临床常用釉牙骨质界到牙槽嵴顶的距离（E错）来判断是牙槽骨是否出现吸收。